呼吸性酸中毒合并代谢性碱中毒的特点是
A. HCO₃⁻和PaCO₂浓度均升高，且超出彼此正常代偿范围
B. SB、AB、BB均升高
C. BE正值增大
D. pH变化不大
E. 以上都是

正确答案：E。以上都是

解析：呼吸性酸中毒合并代谢性碱中毒是酸碱混合型的酸碱平衡紊乱，所以pH变化不大（D对），该型特点为PaCO₂和血浆HCO₃⁻浓度均升高，且超出彼此正常代偿范围（A对）。由于血浆血浆HCO₃⁻浓度升高，AB、SB、BB均升高（B对），BE正值加大（C对，故E为本题正确答案）。